属于非离子型表面活性剂的是
A. 肥皂类
B. 高级脂肪醇硫酸酯类
C. 脂肪族磺酸化物
D. 聚山梨酯类
E. 卵磷脂

正确答案：D。聚山梨酯类

解析：本题考查非离子型表面活性剂。聚山梨酯类（D对）为非离子型表面活性剂。表面活性剂分为阴离子表面活性剂、阳离子表面活性剂、两性离子表面活性剂、非离子表面活性剂和高分子表面活性剂等。肥皂类（A错）、高级脂肪醇硫酸酯类（B错）、脂肪族磺酸化物（C错）均属阴离子表面活性剂；卵磷脂（E错）为两性离子表面活性剂。